适合治疗阳偏衰的治法是
A. 阴病治阳
B. 阳病治阴
C. 阴病治阴
D. 阳病治阳
E. 以上都不是

正确答案：A。阴病治阳

解析：阳虚所引起是虚寒证，应“阴病治阳”，即用温阳的方法温养阳气，抑制阴寒偏盛（A对）；阳病治阴适用于阴虚引起的虚热证（B错）；阴病治阴、阳病治阳阴病治阴均与阳偏衰无关（CDE错）。